在色谱分离中，组分达到平衡时，在固定相中的质量为Ws，浓度为Cs的质量为Wm，浓度为Cm，则此组分的容量因子为
A. Cs/Cm
B. Cm/Cs
C. Ws/Wm
D. Wm/Ws
E. WsCs/WmCm

正确答案：C。Ws/Wm